地震现场，一工人左腰及下肢被倒塌之砖墙压住，震后6小时救出，4小时后送抵医院。诉口渴，尿少，呈暗红色。检查：脉搏120次/min，血压95/70mmHg，左下肢明显肿胀，皮肤有散在淤血斑及水疱，足背动脉搏动较健侧弱，趾端凉，无骨折征。诊断首先考虑
A. 感染性休克
B. 肾挫伤
C. 左下肢挫伤
D. 左下肢血栓形成
E. 挤压伤综合征

正确答案：E。挤压伤综合征

解析：该患者左腰部及下肢（为肌肉丰富的部位）长时间受压，解除挤压后出现尿少，色暗红（提示为血红蛋白尿，考虑有肾功能受损），下肢明显肿胀，足背动脉搏动减弱（提示血栓形成或肢体远端张力过高），应诊断为挤压伤综合征（E对）。挤压伤综合征是指人体四肢或躯干等肌肉丰富的部位遭受重物（如石块、土方等）长时间的挤压，在挤压解除后出现的一系列病理生理改变。临床上主要表现为以肢体肿胀、肌红蛋白尿、高血钾为特点的急性肾功能衰竭。感染性休克（A错）常见于开放性损伤，表现为寒战高热、低血压等。肾挫伤（B错）常有鲜红色肉眼血尿，而不是暗红色血红蛋白尿。左下肢挫伤（C错）一般不会出现肾功能受损的表现（如血尿）。左下肢血栓形成（D错）常表现为下肢疼痛、压痛及肿胀，一般不会出现肾功能受损的表现。